女，20岁。间断多关节痛2年，头晕、茶色尿3天。实验室检查：血常规：Hb65g/L，WBC3.6×10⁹/L，PLT140×10⁹/L，网织红细胞增高，血清间接胆红素增加：尿胆原（＋）尿胆红素（-）；ANA（+）1：1000，Coombs实验（＋），补体C3下降。首选的治疗措施是
A. 大剂量糖皮质激素静脉注射
B. 大剂量环磷酰胺静脉冲击
C. 小剂量环磷酰胺口服
D. 小剂量糖皮质激素口服
E. 输血支持治疗

正确答案：A。大剂量糖皮质激素静脉注射

解析：患者关节痛，头晕、茶色尿，Hb下降、WBC减少（多系统受累），ANA（+），Coombs实验（＋）（溶血性贫血），补体C3下降。综合患者情况，考虑诊断为SLE。该患者处于活动期。首选的治疗措施是大剂量糖皮质激素静脉注射（A对）。免疫抑制剂（BC错）在病情活动时作为糖皮质激素的联合治疗，加用免疫抑制剂有利于更好地控制SLE活动，保护重要脏器功能，减少复发，以及减少长期激素的需要量和副作用。